用于低分子肝素过量时解救的药品是
A. 氨甲环酸
B. 酚磺乙胺
C. 维生素K₁
D. 鱼精蛋白
E. 血凝酶

正确答案：D。鱼精蛋白

解析：本题考查鱼精蛋白。鱼精蛋白（D对）带有正电荷，可与肝素结合形成稳定的复合物，使肝素失去抗凝血作用。氨甲环酸（A错）适用于防治急性、慢性、局限性或全身性原发性纤维蛋白溶解亢进所致的各种出血。酚磺乙胺（B错）适用于防治各种手术前后的出血。维生素K₁（C错）适用于维生素K₁缺乏引起的出血。血凝酶（E错）适用于出血及出血性疾病，也可用来预防手术部位及手术后出血。